丹参中脂溶性有效成分是
A. 丹参素
B. 丹参酸甲
C. 原儿茶酸
D. 原儿茶醛
E. 丹参酮ⅡA

正确答案：E。丹参酮ⅡA

解析：本题考查的是丹参的化学成分。丹参中脂溶性有效成分是丹参酮ⅡA（E对）。丹参的化学成分主要包括脂溶性成分和水溶性成分两大部分。脂溶性成分大多为共轭醌、酮类化合物。如丹参酮Ⅰ、丹参酮ⅡA、丹参酮ⅡB、隐丹参酮等。《中国药典》采用高效液相色谱法测定丹参中丹参酮类和丹酚酸B的含量，要求丹参酮ⅡA、隐丹参酮和丹参酮Ⅰ的总量不得少于0.25%，丹酚酸B不得少于3.0%。另外，水溶性成分则包括丹参素（A错），丹参酸A（B错）、丹酚酸B，原儿茶酸（C错），原儿茶醛（D错）等。